对原生环境描述不正确的是
A. 是天然形成并基本上未受人为活动影响的自然环境
B. 其中存在有许多对人体及其他生物体有利的因素
C. 其中良好的微小气候和优美的绿化等对健康都起促进作用
D. 有些原生环境中存在某些异常现象
E. 原生环境中不会存在影响健康的危险因素

正确答案：E。原生环境中不会存在影响健康的危险因素

解析：本题考查原生环境。原生环境是指天然形成的未受或少受人为因素影响的环境（A对），其中存在大量对人体健康有益的因素（B对），如清洁并含有正常化学成分，空气、水、土壤,充足的阳光和适宜的气候条件，秀丽的风光等都是对人体健康的有益因素（C对）。原生环境中也存在一些对人体健康不利（D对）的因素（E错，为本题正确答案），例如由于地壳表面化学元素分布的不均匀性，使某些地区的水和（或）土壤中某些元素过多或过少，居民通过饮水、食物等途径摄入这些元素过多或过少而引起的特异性疾病，称为生物地球化学性疾病。